下列口腔癌的流行特征，正确的是
A. 东南亚地区发病率最高
B. 发病情况与时间变化无关
C. 患病年龄有偏低的趋势
D. 男女患病比例接近1：1
E. 不同种族发病率相似

正确答案：A。东南亚地区发病率最高

解析：本题考查口腔癌的流行特征。下列口腔癌的流行特征，正确的是东南亚地区发病率最高（A对）。口腔癌的流行特征：1.地区分布：口腔癌在全世界都有发现，不同地区发病率不同，以东南亚地区发病率最高，如孟加拉、缅甸、柬埔寨、印度、马来西亚、尼泊尔、巴基斯坦、新加坡、斯里兰卡、泰国和越南，这是因为当地居民有咀嚼烟草和槟榔的习惯。2.时间分布（B错）：不同国家和地区的口腔癌发病率随时间而变化。3.年龄分布：口腔癌可发生于所有人群，成年人好发。国内发病率的高峰为40～60岁，而西方国家的发病高峰在60岁以上，但近年来，不管是我国还是西方国家，患病年龄有老龄化的趋势（C错），主要原因可能与人群的平均寿命延长有关。口腔癌的发病率随年龄的增长而升高。4. 性别分布：男女都可以发生口腔癌，但男性明显高于女性，比例接近2：1（D错）。5.种族差异：口腔癌在不同种族发病率不同（E错）。在新加坡，印度裔人口腔癌发病率高于华人和马来西亚人，这可能与咀嚼烟草的习惯有关。